无黏膜下层的是
A. 唇红黏膜
B. 颊黏膜
C. 口底黏膜
D. 舌腹黏膜
E. 舌背黏膜

正确答案：E。舌背黏膜

解析：本题考查口腔黏膜。无黏膜下层的是（E错，为本题的正确答案）。口腔黏膜根据所在的部位和功能可分为三类，即咀嚼黏膜、被覆黏膜和特殊黏膜。咀嚼黏膜包括牙龈和硬腭黏膜；被覆黏膜包括唇（A对）、颊黏膜（B对）、软腭黏膜、口底（C对）和舌腹黏膜（D对）；特殊黏膜即舌背黏膜。黏膜下层主要分布在被覆黏膜，在牙龈、硬腭的大部分区域及舌背无黏膜下层。